下述哪些与盐酸吗啡不符
A. 分子中有五个不对称碳原子，具旋光性
B. 光照下能被空气氧化变质
C. 其中性水溶液较稳定
D. 和甲醛硫酸溶液显紫堇色
E. 为镇痛药

正确答案：C。其中性水溶液较稳定